流脑患者的血标本送细菌学接种时必须在标本采集后立即送验，主要因为
A. 该菌离开人体得不到营养
B. 立即产生自溶酶
C. 需严格厌氧不能在空气中暴露
D. 对寒冷干燥极为敏感，在体外易自溶
E. 标本搁置过久易污染

正确答案：D。对寒冷干燥极为敏感，在体外易自溶